诊断急进性肾小球肾炎最有价值的指标是
A. BUN、Scr迅速升高
B. 50％以上肾小球囊内有大新月体形成
C. 尿量减少但蛋白排泄量增加
D. 血清抗中性粒细胞胞浆抗体阳性
E. 影像学检查显示双肾增大

正确答案：B。50％以上肾小球囊内有大新月体形成

解析：急进性肾小球肾炎是以急性肾炎综合征、肾功能急剧恶化、多在早期出现少尿性急性肾衰竭为临床特征，本病的病理类型为新月体性肾小球肾炎，其诊断最有价值的指标是病理检查可见50％以上肾小球囊内有大新月体形成（B对），其他类型的肾脏疾病虽可有新月体的形成，但新月体范围有限。BUN、Scr迅速升高（九版诊断学P342）（A错）可见于急性肾炎及肾衰等多种疾病；尿量减少但蛋白排泄量增加（九版诊断学P304）（C错）可见于多种肾脏及肾外疾病，表现为蛋白尿；血清抗中性粒细胞胞浆抗体阳性（九版诊断学P430）（D错）主要见于各种血管炎患者，如韦格纳肉芽肿、Ⅲ急进性肾小球肾炎、微小多动脉炎等；影像学检查显示双肾增大（E错）可见于急性肾炎、急进性肾小球肾炎等多种疾病，以上检查特异性均较低。